男，57岁，体检发现血糖升高。既往有高血压、高脂血症史。其母患糖尿病。查体。BP160/100mmHg，身高175cm，体重90kg。双肺听诊未见异常。心率76次/分，律齐，肝脾肋下未触及，实验室检查：空腹血糖7.8mmol/L，HbAlc8.0%。下列降压药物中，应首选的是
A. 血管紧张素转换酶抑制剂
B. 钙通道阻滞剂
C. α受体拮抗剂
D. β受体拮抗剂
E. 利尿剂

正确答案：A。血管紧张素转换酶抑制剂

解析：患者老年男性，体检发现血糖升高，既往有高血压、高血脂症病史（糖尿病高危因素）。其母患糖尿病（家族史）。查体：BP160/100mmHg（正常值90～130/60～80mmHg，提示高血压2级），身高175cm，体重90kg（BMI＞24提示肥胖，BMI=体重kg/身高㎡）。实验室检查：空腹血糖7.8mmol/L（正常值3.9～6.1mmol/L，提示糖尿病），HbAlc8.0%（正常值＜6.5%）。综合病史、体查和实验室检查，患者可诊断为糖尿病伴高血压2级。对于高血压合并糖尿病的患者降血压首选的治疗药物是血管紧张素转化酶抑制剂（ACEI）（A对）。ACEI可抑制交感-肾素-血管紧张素-醛固酮系统，扩张外周血管而降低血压；还可改善胰岛素抵抗、减少尿蛋白形成，因此特别适合于高血压合并糖尿病的患者。钙通道阻滞剂（P255）（B错）对血脂、血糖等无明显影响，而患者有高脂血症（正常值0.56～1.70mmol/L），因此其不能作为本例首选。用于抗高血压治疗的α受体阻滞剂（C错）（P255）主要为α₁受体阻滞剂，如哌唑嗪、特拉唑嗪等，因其副作用较多，目前不主张单独使用。β受体阻滞剂（D错）（P253）能增加胰岛素抵抗，还可能掩盖和延长低血糖反应，利尿剂（E错）可使血脂、血糖、血尿酸升高，两者都不适合用于高血压合并糖尿病的患者。